热能密度最高的营养素是
A. 脂肪
B. 单糖
C. 碳水化合物
D. 各类蛋白质
E. 动物蛋白质

正确答案：A。脂肪